在有500名病例，500名对照的研究中，其中有400名病例，100名对照发现有所怀疑的病因，因此，相对危险性是
A. 0.5
B. 0.6
C. 0.7
D. 0.8
E. 所给资料不能计算

正确答案：E。所给资料不能计算

解析：本题考查相对危险度的用途。相对危险度是描述暴露与疾病联系强度的指标，用于队列研究。题中的研究方法为病例对照研究，该方法无法计算发病率，无法计算出相对危险度（E对ABCD错）。